HIV造成机体免疫功能损害主要侵犯的细胞是
A. CD4⁺T淋巴细胞
B. CD8⁺T淋巴细胞
C. B淋巴细胞
D. NK细胞
E. 浆细胞

正确答案：A。CD4⁺T淋巴细胞